喘憋性肺炎常见的病原体是
A. 腺病毒
B. 金黄色葡萄球菌
C. 呼吸道合胞病毒
D. 肺炎链球菌
E. 肺炎支原体

正确答案：C。呼吸道合胞病毒

解析：喘憋性肺炎，起病急骤呈爆发性流行，2岁以下小儿多发，多数起病即严重喘憋，临床表现以喘憋和阵发性喘憋加重为特征，有明显的呼吸道梗阻症状，表现为呼气性呼吸困难，呼气延长，鼻翼煽动，三凹征明显，主要感染病毒是呼吸道合胞病毒（C对）。腺病毒（A错）肺炎主要见于婴幼儿，一般表现为急骤发热，最初1～3天，体温多在38～39℃，以后渐升高，4～5天，半数病例可达40℃以上，呈稽留热或不规则热型，高热持续7～10天，重症2周为极期，以后退热。金黄色葡萄球菌（P48）（B错）肺炎多起病急骤，高热、寒战、胸痛，脓性痰等。肺炎链球菌（P46）（D错）肺炎以高热、寒战、咳嗽、铁锈色痰或血痰及胸痛为特征。肺炎支原体（P49）（E错）肺炎起病缓慢，主要表现为乏力、咽痛、头痛、咳嗽、发热、食欲不振、腹泻、肌痛、耳痛等，咳嗽多为阵发性刺激性呛咳。